反映甲状腺功能状态的最好指标是
A. 血浆总T₃、T₄浓度
B. 血浆结合型T₃T₄浓度
C. 血浆FT₄浓度
D. 血浆游离甲状腺素浓度
E. 血浆甲状腺素结合能力

正确答案：D。血浆游离甲状腺素浓度

解析：游离甲状腺素是实现该激素生物效应的主要部分。尽管FT₄仅占T₄的0.025%。FT₃仅占T₃的0.35%，但它们与甲状腺激素的生物效应密切相关，所以是诊断临床甲亢的首选指标（D对）。血浆总T₃、T₄浓度是判断甲状腺功能亢进或甲状腺功能低下症常用的指标（A错）。血浆结合型T₃T₄浓度不能进入外周组织细胞，只有转化后才能进入细胞发挥其生理功能（BE错）。血浆FT₄浓度是甲状腺功能体外试验的灵敏指标，即使在生理及病理情况下引起血浆甲状腺结合蛋白结合力和浓度改变时，也能较准备反映甲状腺的功能（C错）。